药品生产企业质量管理部门负责评价原料、中间产品及成品质量的
A. 合法性
B. 相容性
C. 相关性
D. 安全性
E. 稳定性

正确答案：E。稳定性